女，45岁。确诊为子宫内膜癌，手术切除后病理示癌局限在子宫内膜。该患者的手术病理分期为
A. ⅠA
B. ⅠC
C. ⅡA
D. ⅠB
E. ⅢA

正确答案：A。ⅠA

解析：I期：肿瘤局限于宫体 IA：肿瘤浸润深度＜1/2肌层； IB：肿瘤浸润深度≥1/2肌层。癌局限在子宫内膜属于ⅠA期（A对）。ⅠC（B错）为癌侵犯＞1/2肌层。ⅡA期（C错）为癌累及宫颈黏膜腺体。ⅠB期（D错）为癌侵犯≥1/2肌层。ⅢA期（E错）为癌侵犯浆膜和（或）附件。需要指出的是，第八版妇产科学（P315）中的表30-1是FIGO于2009年修订的手术病理分期，但是题干中有提到ⅠC的概念，在2009年修订版本中，Ⅰ期只分为了AB，而题干中提到ⅠC为FIGO在1988年提出的病理分期，在老版本的分期中，ⅠA为病变局限于子宫内膜，ⅠB病变浸润＜1/2肌层，ⅠC病变浸润＞1/2肌层。本题数据属于老数据，但解析中除了ⅠC都是以最近数据进行解释的。